有关药液浓缩知识的叙述，错误的是
A. 蒸发浓缩是药液浓缩最常用的方法
B. 减压浓缩使药液在低于1个大气压下蒸发，增大了传热温度差，提高了蒸发效率
C. 薄膜浓缩是使药液在蒸发时形成薄膜和泡沫增加气化表面的蒸发浓缩方法
D. 提高总传热系数K值是提高蒸发效率的主要因素
E. 三效浓缩器的蒸发温度从一效至三效依次升高

正确答案：E。三效浓缩器的蒸发温度从一效至三效依次升高